医生采取“多头堵”，“大包围”的方式开具大处方，违背的伦理学要求是
A. 严守法规
B. 公正分配
C. 加强协作
D. 合理配伍
E. 对症下药

正确答案：D。合理配伍

解析：合理配伍（D对）是药物治疗对医生的道德要求。医生采取“多头堵”，“大包围”的方式开具大处方，违背了该伦理学要求。严守法规（A错）是当患者要求住院医师开具精神药品时，医师应当遵循的伦理要求。对症下药（E错）是医生根据临床诊断选择相应的药物进行治疗遵循的医学伦理学要求。